修复前口腔的一般处理不包括
A. 保证良好的口腔卫生
B. 牙齿选磨
C. 拆除不良修复体
D. 治疗和控制龋病及牙周病
E. 处理急性症状

正确答案：B。牙齿选磨

解析：本题考查修复前口腔的一般处理。牙齿选磨（B错，为本题正确答案）是修复前口腔的一般处理不包括的。牙齿选磨为咬合调整与选磨部分的内容。修复前口腔的一般处理包括：1.处理急性症状（E对），对由牙折、急性牙髓炎、慢性牙髓炎急性发作、牙槽脓肿、急性冠周炎或龈炎，以及颞下颌关节紊乱病引起的不适，应及时处理；2.保证良好的口腔卫生（A对），口腔卫生状况直接关系到牙龈、牙周组织的健康以及修复效果和修复体的使用寿命，同时，牙结石、牙垢等在牙面上的大量附着，将影响印模的准确性，所以修复前对牙结石和牙垢应彻底洁治清除；3.拆除不良修复体（C对），对设计不当、制作粗糙、质量低劣、危害口腔健康的修复体，以及已丧失原设计功能的修复体，应予以拆除；4.治疗和控制龋病及牙周病（D对），包括了龋病治疗和牙周治疗。